男，60岁，唇部有一包块，常有溃疡，边缘较硬，与周围组织粘连，不活动。镜下可见癌细胞向黏膜下层浸润生长，呈团块状排列，形成癌巢，中间可见角化珠。癌巢周边立方状基底细胞中可见核分裂相。病理诊断为：
A. 鳞状细胞癌
B. 基底细胞癌
C. 乳头状瘤
D. 腺癌
E. 未分化癌

正确答案：A。鳞状细胞癌

解析：本题考查鳞状细胞癌。此患者发病部位为唇部，且唇部包块与周围组织粘连，不活动，可初步诊断为唇癌。镜下见癌细胞向黏膜下层浸润生长，呈团块状排列，形成癌巢，中间可见角化珠。此患者上述临床症状及镜下表现符合鳞状细胞癌（A对）的特点。基底细胞癌（B错）多见于颌面部皮肤，镜下见癌细胞体积小，胞浆少，有特征性的外侧细胞栅栏和环绕癌巢周围的疏松纤维粘液间质，与题干描述不符。乳头状瘤（C错）镜下可见肿瘤呈乳头状增生，乳头中心为伴有毛细血管的纤维组织，细胞间质可见鳞状上皮化生，与题干描述不符。腺癌（D错）、未分化癌（E错）的病理改变（《口腔组织病理学（第八版）》未明确说明。